小儿右髋部摔伤，首选的X线检查方法是
A. 透视检查
B. 摄右髋关节正位片
C. 摄右髋关节侧位片
D. 摄右髋关节正侧位片
E. 摄骨盆正位片，包括两侧髋关节

正确答案：E。摄骨盆正位片，包括两侧髋关节

解析：X线片摄影要注意任何部位，包括四肢长骨、关节和脊柱都要用正位、侧位。某些部位还要用斜位、切线位和轴位等，所以小儿右髋部摔伤应摄骨盆正位片，包括两侧髋关节（E对）。